患者，女性，67岁，间断胸痛2年，均发生于夜间睡眠时，持续25分钟左右，可自行缓解。胸痛发作时心电图示：V1～V6导联ST段抬高0.4mV，胸痛缓解后心电图ST段恢复正常。该患者最可能的诊断是
A. 初发劳累性心绞痛
B. 稳定型劳累性心绞痛
C. 恶化型劳累性心绞痛
D. 变异型心绞痛
E. 急性心肌梗死

正确答案：D。变异型心绞痛